某医师随机抽样调查了500例本地产妇及400例外来人口中产妇的如下指标：婴儿性别、产妇年龄年人均收入（元）、产前检查次数、是否有妊娠高血压综合征、有无子痫、基础血压（mmHg）等。要分析本地产妇及外来人口中产妇平均年龄的不同，应该首选的统计分析方法是
A. 行✕列表X²检验
B. 四格表X²检验
C. 相关分析
D. 配对X²检验
E. 方差分析

正确答案：E。方差分析